欲使（牙合）支托所承受的作用力顺基牙长轴方向传递，（牙合）支托凹底应与基牙长轴垂线成
A. 90°角
B. 20°角
C. 60°角
D. 30°角
E. 45°角

正确答案：B。20°角

解析：本题考查（牙合）支托与基牙关系。基牙上的支托凹底，应与基牙长轴垂直。但是生物力学研究证明支托凹底应与基牙长轴垂线成正20°（B对）角时，基牙牙周应力分布最均匀，即支托所承受的作用力顺基牙长轴方向传递，不易使基牙倾斜移位。